女，65岁。诊断2型糖尿病1年，饮食运动控制，检测空腹血糖7.5mmol/L，餐后2h血糖11.4mmol/L.既往体健，查体身高160cm，体重70kg，心肺查体未见异常。患者服药后2个月复诊，糖化血红蛋白6.3%。患者目前降糖治疗方案首选是
A. 加用瑞格列奈
B. 加用阿卡波糖
C. 维持二甲双胍
D. 换用格列喹酮
E. 换用胰岛素

正确答案：C。维持二甲双胍

解析：该患者服药后2个月复诊，糖化血红蛋白6.3%（＜6.5%），没有禁忌证，可维持服用二甲双胍（C对）。如单独使用二甲双胍治疗血糖未达标，可加用其他种类的降糖药物（ABD错）。两种口服药联合冶疗而血糖仍不达标者，可采用3种口服药联合治疗，或加用胰岛素治疗（E错）。